下唇皮肤的感觉神经主要是
A. 舌下神经
B. 面神经
C. 舌咽神经
D. 上颌神经
E. 颏神经

正确答案：E。颏神经

解析：下唇皮肤的感觉神经主要是颏神经（E对）。舌下神经（A错）支配舌内肌和大部分舌外肌运动。面神经（B错）支配面部表情肌运动、泪腺等腺体分泌，传导舌前2/3味觉等。舌咽神经（C错）支配茎突咽肌运动、腮腺分泌，传导舌后1/3黏膜感觉及味觉等。上颌神经（D错）传导口鼻腔黏膜、睑裂与口裂之间的皮肤感觉等。